对于急性病病人的治疗，宜采取的医患关系模式是
A. 主动被动型
B. 被动主动型
C. 指导合作型
D. 共同参与型
E. 合作指导型

正确答案：C。指导合作型